胆酸在小肠上段吸收的转运方式属于
A. 易化扩散
B. 主动转运
C. 膜孔过滤
D. 膜动转运
E. 简单扩散

正确答案：B。主动转运

解析：本题考查药物的转运方式。胆酸的运输方式为主动转运（B对），具有部位特异性，只在小肠上段进行。